患者，男，60岁，因水疱型足癣到药店购药，药师应推荐的药品是
A. 利巴韦林软膏
B. 特比萘芬乳膏
C. 10%樟脑软膏
D. 氢化可的松软膏
E. 红霉素软膏

正确答案：B。特比萘芬乳膏

解析：本题考查水疱型足癣常用药。特比萘芬乳膏（B对）可用于治疗水疱型足癣。除此外患者可外搽复方苯甲酸酊、十一烯酸软膏，或用10%冰醋酸溶液浸泡或应用咪康唑乳膏，外用涂擦，一日1～2次，连续2～4周。利巴韦林软膏（A错）是抗病毒药，用于单纯疱疹病毒性角膜炎。10%樟脑软膏（C错）用于治疗轻度冻疮。红霉素软膏（E错）用于严重冻疮合并严重感染者。氢化可的松软膏（D错）属于糖皮质激素类软膏，用于治疗亚急性、慢性湿疹。